男，65岁。大量饮酒30年，临床诊断肝硬化失代偿期。对评估病情最重要的临床表现是
A. 腹水
B. 脾进行性增大
C. 上消化道出血
D. 贫血
E. 出现蜘蛛痣和肝掌

正确答案：A。腹水

解析：腹水是肝硬化失代偿期最突出的临床表现，对病情评估有重要作用（ A对）。门脉高压早期由于血液淤积与脾脏，脾可以进行性增大，不益作为失代偿期评估病情指标（B错）。上消化出血多由进食坚硬的食物等诱因引发，随机性强，不益作为评估病情的表现（C错）。蜘蛛痣和肝掌、贫血多为病情长期进展的结果，变换较缓慢，不能及时反映失代偿期病情变化（DE错）。